8岁患儿，浮肿少尿4天，近1天来诉头痛、头昏、呕吐并抽搐1次，查体：体温37.3℃，血压170/120mmHg，血BUN7.8mmol/L，尿常规示：蛋白++，红细胞＞100个/HP，白细胞30个/HP，该患儿准确的诊断为
A. 急进性肾炎
B. 慢性肾炎急性发作
C. 肾炎性肾病，高血压脑病
D. 急性肾炎，高血压脑病
E. 急性肾炎，颅内出血

正确答案：D。急性肾炎，高血压脑病

解析：患儿8岁提示为学龄儿童，近1天来诉头痛头昏呕吐并抽搐1次，符合高血压脑病的临床表现。同时该患儿出现浮肿少尿提示急性肾炎，血压170/120mmHg及红细胞＞100个/HP符合急性肾炎的实验室检查，且高血压脑病为急性肾炎的严重表现，故综上该患儿准确的诊断为急性肾炎，高血压脑病（D对）。慢性肾炎急性发作（B错）首先要有一个较长时间的病史，多见于中老年人，该患儿仅8岁，故不考虑此病。根据肾炎性肾病的诊断标准，该患儿并不符合（C错）。